肉桂的原植物属于
A. 芸香科
B. 茄科
C. 樟科
D. 木兰科
E. 毛茛科

正确答案：C。樟科

解析：本题考查的是肉桂的来源。肉桂的原植物属于樟科（C对）。肉桂：【来源】为樟科植物肉桂的干燥树皮。来源于芸香科（A错）的中药有黄柏、关黄柏、白鲜皮、枳壳、吴茱萸等。来源于茄科（B错）的中药有地骨皮、洋金花、枸杞子、天仙子等。来源于木兰科（D错）的中药有厚朴、辛夷、五味子、南五味子等。来源于毛茛科（E错）的中药有威灵仙、川乌、附子、白芍、赤芍、升麻等。